女性，25岁。心悸，气促，下肢水肿4年，望诊心脏负性心尖搏动，己排除粘连性心包炎，可发现下列哪项体征
A. 叩诊心脏呈靴型增大
B. 心前区隆起
C. 心音遥远
D. 胸骨左缘扪及收缩期震颤
E. 交替脉

正确答案：B。心前区隆起

解析：负性心尖搏动是指心脏收缩时心尖搏动内陷，见于粘连性心包炎，也见于重度右室肥大。重度右室肥大时，心脏顺钟向转位，左心室向后移位，引起负性心尖搏动。右室肥大时，可有心前区隆起（B对）。心脏呈靴型增大（A错）常见于主动脉瓣关闭不全，也见于主动脉瓣狭窄（P150）。心音遥远（C错）常见于心包积液。胸骨左缘扪及收缩期震颤（D错）提示肺动脉瓣狭窄或者室间隔缺损（P149）。交替脉（E错）提示左心功能不全（P163）。